下述哪项不是溃疡性结肠炎的常见并发症
A. 中毒性巨结肠
B. 直肠结肠出血
C. 癌变
D. 多发性瘘管
E. 急性肠穿孔

正确答案：D。多发性瘘管

解析：溃疡性结肠炎的并发症包括：①中毒性巨结肠（A对）：见于5％的重症UC（溃疡性结肠炎）患者，常因低钾、钡剂灌肠、使用抗胆碱能药物或阿片类制剂而诱发。②直肠结肠癌变（C对）：发生率约5％～10％。③直肠结肠出血（B对）：发生率约3％。④急性肠穿孔（E对）：多与中毒性巨结肠有关。⑤肠梗阻：少见，发生率远低于克罗恩病。溃疡性结肠炎病变主要限于大肠黏膜与黏膜下层，很少深入肌层，所以极少发生多发性瘘管（P374）（D错，为本题正确答案）。瘘管形成为克罗恩病的特征性临床表现（P377）。